某女，45岁。素体虚弱，畏寒肢冷，抑郁寡欢。近日，因家庭琐事导致情志不畅，致使头痛、吐涎沫。证属中寒肝逆，宜选用的药是
A. 肉桂
B. 干姜
C. 吴茱萸
D. 荜茇
E. 小茴香

正确答案：C。吴茱萸

解析：本题考查的是吴茱萸的主治病证。某女，45岁。素体虚弱，畏寒肢冷，抑郁寡欢。近日，因家庭琐事导致情志不畅，致使头痛、吐涎沫。证属中寒肝逆，宜选用的药是吴茱萸（C对）。吴茱萸：【主治病证】（1）中寒肝逆之头痛、吐涎沫。（2）寒湿脚气肿痛，或上冲入腹之腹胀、困闷欲死。（3）寒疝腹痛，经寒痛经。（4）呕吐吞酸。（5）虚寒腹痛泄泻。肉桂（A错）：【主治病证】（1）肾阳不足、命门火衰之阳痿、宫冷、畏寒肢冷。（2）下元虚冷、虚阳上浮之上热下寒证。（3）阳虚中寒之脘腹冷痛、食少便溏。（4）经寒血滞之痛经、闭经，寒疝腹痛，寒湿痹痛，腰痛。（5）阴疽，痈肿脓成不溃或久溃不敛。干姜（B错）：【主治病证】（1）脾胃受寒或虚寒所致的腹痛、呕吐、泄泻。（2）亡阳欲脱。（3）寒饮咳喘。荜茇（D错）：【主治病证】（1）脘腹冷痛，中寒呕吐、泄泻。（2）胸痹冷痛，龋齿牙痛。小茴香（E错）：【主治病证】（1）寒疝腹痛，睾丸偏坠胀痛，经寒痛经。（2）胃寒呕吐，寒凝气滞之脘腹胀痛。